对处方调配的错误叙述是
A. 接到处方后应再次进行审方
B. 要使用经检验合格的戥秤
C. 对一方多剂的处方应估量分剂
D. 调配完毕后应由专人复核
E. 要按处方药物所列的顺序调配

正确答案：C。对一方多剂的处方应估量分剂